六淫中最具有明显季节性的邪气是
A. 风
B. 寒
C. 暑
D. 湿
E. 燥

正确答案：C。暑

解析：本题考查的是六淫致病的特点。六淫中最具有明显季节性的邪气是暑（C对）。暑邪的性质及致病特点：凡致病具有炎热、升散、兼湿特性的外邪，发病于夏至之后，立秋以前，称为暑邪。（1）暑为阳邪，其性炎热：暑为夏季火热之气所化，火热属阳，故暑为阳邪。暑邪伤人，多表现出阳热亢盛症状。（2）暑性升散，耗气伤津：暑为阳邪，有升发之特点，故暑邪侵犯人体，多直入气分，可使腠理开泄而多汗。暑热之邪，易于扰乱心神，则见心烦闷乱、神不安宁等。由于大量汗出，气随津泄而致气虚。所以，外伤暑邪，可见气短乏力，甚则突然昏倒、不省人事等。（3）暑多挟湿：夏季气候炎热，且雨水较多，热蒸湿动，空气中湿度增加，故暑邪致病，多挟湿邪，即暑邪湿邪合而致病。其临床表现是除发热、心烦、口渴外，还常兼见四肢困倦、胸闷恶心、大便溏泄或不爽等湿邪致病症状。风（A错）邪为病，以春季为多见，但终岁常在，四季皆有。寒（B错）邪常见于冬季，当水冰地坼之时，伤于寒者为多，故冬多寒病；但寒邪为病也可见于其他季节，如气温骤降、贪凉露宿、空调过冷、恣食生冷等，亦常为感受寒邪的重要原因。湿（D错）邪为病，长夏居多，但四季均可发生。燥（E错）为秋季的主气，但一年四季皆可发生。